不参加构成腹腔丛的神经是
A. 迷走神经前干
B. 迷走神经后干
C. 内脏大神经
D. 内脏小神经
E. 腹腔神经节的节后纤维

正确答案：A。迷走神经前干

解析：腹腔丛由来自两侧的胸交感干的内脏大、小神经（CD对）和迷走神经后干（B对A错，为本题正确选项）的腹腔支以及腰上部交感神经节的分支（E对）共同构成。